阻塞性窒息的急救措施错误的是
A. 悬吊下坠的上颌骨骨块
B. 采取仰卧位
C. 将后坠的舌牵出
D. 及早清除口、鼻腔及咽喉部异物
E. 插入通气导管保持呼吸道通畅

正确答案：B。采取仰卧位

解析：阻塞性窒息的急救：①及早清除口、鼻腔及咽喉部异物；②将后坠的舌牵出；③悬吊下坠的上颌骨骨块；④插入通气导管保持呼吸道通畅。掌握“口腔颌面部创伤急救”知识点。